影响皮肤辐射散热的主要因素是
A. 环境温度
B. 皮肤温度
C. 机体与环境之间的温差
D. 风速
E. 环境的湿度

正确答案：C。机体与环境之间的温差